2岁到青春前期，体重每年增加
A. 0.5kg
B. 1kg
C. 1.5kg
D. 2kg
E. 2.5kg

正确答案：D。2kg

解析：本题为记忆题。2岁至青春前期小儿体重每年增长约2kg（D对）。